血清中HBeAg阳性时，说明
A. 无传染性
B. 病情比较稳定
C. 曾感染乙肝病毒
D. 具有免疫力
E. 具有较大传染性

正确答案：E。具有较大传染性

解析：HBeAg阳性常有HBcAg阳性，表示HBV在复制，传染性强（E对AB错）。HBsAg（-）抗HBs（+）HBeAg（-）抗HBe（-）抗HBc（-）表明注射过乙型病毒性肝炎疫苗，有免疫力，既往感染（CD错）。